将维A酸制成环糊精包合物的目的主要是
A. 降低维A酸的溶出度
B. 减少维A酸的挥发性损失
C. 产生靶向作用
D. 提高维A酸的稳定性
E. 产生缓释效果

正确答案：D。提高维A酸的稳定性

解析：本题考查包合技术的特点。将维A酸制成环糊精包合物的目的主要是提高维A酸的稳定性（D对）。包合技术系指一种分子被包藏于另一种分子的空穴结构内，形成包合物的技术。包合技术的特点：①可增加药物溶解度和生物利用度；②掩盖药物的不良气味，降低药物的刺激性；③减少挥发性成分的损失，使液体药物粉末化；④对易受热、湿、光等影响的药物，包合后可提高稳定性。